荆防颗粒适用于
A. 风热感冒
B. 暑湿感冒
C. 气虚外感
D. 风寒感冒
E. 阴虚外感

正确答案：D。风寒感冒

解析：本题考查的是荆防颗粒的主治。荆防颗粒适用于风寒感冒（D对）。荆防颗粒：【主治】外感风寒挟湿所致的感冒，症见头身疼痛、恶寒无汗、鼻塞流涕、咳嗽。银翘解毒丸：【主治】风热感冒（A错），症见发热、头痛、咳嗽、口干、咽喉疼痛。藿香正气水：【主治】外感风寒，内伤湿滞或夏伤暑湿所致的感冒（B错），症见头痛昏重、胸膈痞闷、脘腹胀痛、呕吐泄泻；胃肠型感冒见上述证候者。白术：【主治病证】（1）脾胃气虚之食少便溏、倦怠乏力。（2）脾虚水肿，痰饮。（3）表虚自汗。（4）脾虚气弱之胎动不安。治气虚自汗、气虚外感（C错）多汗及脾虚胎动不安当用白术。白薇：【主治病证】（1）阴虚发热，骨蒸潮热，产后虚热，阴虚外感（E错）。（2）温病热入营血证，肺热咳嗽。（3）热淋，血淋。（4）痈肿疮毒，咽喉肿痛，毒蛇咬伤。